根据《处方管理办法》，药师对处方用药适宜性审核的内容包括
A. 药品金额的准确性
B. 剂量、用法的正确性
C. 是否有重复给药现象
D. 处方用药与临床诊断的相符性
E. 选用剂型与给药途径的合理性

正确答案：B、C、D、E。剂量、用法的正确性；是否有重复给药现象；处方用药与临床诊断的相符性；选用剂型与给药途径的合理性

解析：本题考查的是处方审核。药师对处方用药进行适宜性审核的内容包括剂量、用法的正确性（B对）；是否有重复给药现象（C对）；处方用药与临床诊断的相符性（D对）；选用剂型与给药途径的合理性（E对）。处方的适宜性审核包括：①西药及中成药处方，应当审核以下项目：处方用药与诊断是否相符；规定必须做皮试的药品，是否注明过敏试验及结果的判定；处方剂量、用法是否正确，单次处方总量是否符合规定；选用剂型与给药途径是否适宜；是否有重复给药和相互作用情况，包括西药、中成药、中成药与西药、中成药与中药饮片之间是否存在重复给药和有临床意义的相互作用；是否存在配伍禁忌；是否有用药禁忌：儿童、老年人、孕妇及哺乳期妇女、脏器功能不全患者用药是否有禁忌使用的药物，患者用药是否有食物及药物过敏史禁忌证、诊断禁忌证、疾病史禁忌证与性别禁忌证；溶媒的选择、用法用量是否适宜，静脉输注的药品给药速度是否适宜；是否存在其他用药不适宜情况。②中药饮片处方，应当审核以下项目：中药饮片处方用药与中医诊断（病名和证型）是否相符；饮片的名称、炮制品选用是否正确，煎法、用法、脚注等是否完整、准确；毒麻贵细饮片是否按规定开方；特殊人群如儿童、老年人、孕妇及哺乳期妇女、脏器功能不全患者用药是否有禁忌使用的药物；是否存在其他用药不适宜情况。